50岁，女性。患心绞痛2年余，因情绪激动突然发作比以前严重的胸痛，疑为急性心肌梗死。以下哪项最有诊断价值
A. ST段明显下移
B. T波明显倒置
C. Q波大于同导联R波1/5
D. 血中肌红蛋白增高
E. GPT升高

正确答案：D。血中肌红蛋白增高

解析：肌红蛋白为血清心肌坏死标志物，常在起病后2小时内升高，12小时内达高峰，在急性心肌梗死后出现最早，也十分敏感。因此血中肌红蛋白增高（D对）对病人诊断急性心肌梗死最有诊断价值。ST段明显下移虽可见于非ST段抬高型心肌梗死，但也可见于心绞痛，所以对诊断急性心肌梗死价值不大（A错）。T波明显倒置（B错）于ST段抬高型心肌梗死数周至数月后出现，为慢性期改变，对诊断突发急性心肌梗死价值不大。病理性Q波是指Q波振幅大于同导联R波的1/4，Q波大于同导联R波1/5（C错）并无诊断意义。GPT（谷丙转氨酶）增高主要见于急性肝炎，对诊断急性心肌梗塞价值不大（E错）。